对乙酰氨基酚大量应用所致的不良反应是
A. 血尿酸和肌酐升高
B. 呼吸窘迫综合征
C. 肝坏死
D. 深静脉血栓形成
E. 骨质疏松症

正确答案：C。肝坏死

解析：本题考查对乙酰氨基酚的不良反应。对乙酰氨基酚大量应用所致的不良反应是肝坏死（C对）。长期用药或过量中毒导致体内谷胱甘肽被耗竭时，此毒性产物以共价键形式与肝、肾中重要的酶和蛋白质不可逆性结合，引起肝细胞、肾小管细胞损伤。